尿素在肝的合成部位是
A. 胞浆和微粒体
B. 胞浆和线粒体
C. 线粒体和微粒体
D. 微粒体和高尔基体
E. 胞浆和高尔基体

正确答案：B。胞浆和线粒体

解析：人体合成尿素的主要器官是肝，鸟氨酸循环主要在肝内胞浆和线粒体中进行（B对），在肝中通过鸟苷酸循环由氨合成尿素，在氨解毒中发挥重要的作用。